下列哪一类型的细菌性食物中毒是典型的毒素中毒型食物中毒
A. 沙门菌食物中毒
B. 变形杆菌食物中毒
C. 葡萄球菌食物中毒
D. 副溶血性弧菌食物中毒
E. 大肠杆菌食物中毒

正确答案：C。葡萄球菌食物中毒